治疗产后抑郁症瘀阻气逆证，应首选
A. 养心汤
B. 归脾汤合甘麦大枣汤
C. 癫狂梦醒汤加酸枣仁
D. 炙甘草汤
E. 逍遥散加夜交藤、合欢皮等

正确答案：C。癫狂梦醒汤加酸枣仁

解析：产后抑郁症瘀阻气逆证的病机是血瘀气逆，闭于心窍，治宜活血化瘀，镇逆安神，选用癫狂梦醒汤加酸枣仁（C对）。养心汤（A错）主治心血亏虚所致的心神不宁证。归脾汤合甘麦大枣汤（B错）主治产后抑郁症心脾两虚证。炙甘草汤（D错）主治阴血不足，阳气虚弱证。逍遥散加夜交藤、合欢皮等（E错）主治产后抑郁症肝郁气结证。